女，45岁。肢体软弱无力，夜尿多2年余，今晨起双下肢不能活动。查：血压170/100mmHg，均匀性轻度肥胖，双下肢松弛性瘫痪，血钾2.4mmol/L。最可能的诊断为
A. 原发性高血压
B. 嗜铬细胞瘤
C. 肾性高血压
D. 原发性醛固酮增多症
E. 库欣病

正确答案：D。原发性醛固酮增多症

解析：中年女性患者，出现慢性肢体软弱无力，突发双下肢不能活动（低钾血症导致骨骼肌细胞超极化，兴奋性降低）、夜尿增多（慢性失钾导致肾小管上皮细胞浓缩功能障碍），高血压（正常值90～120/60～80mmHg）、低血钾（正常值3.5～5.5mmol/L），最可能的诊断为原发性醛固酮增多症（D对）。原发性醛固酮增多症患者血中过量醛固酮作用于肾远曲小管与集合管可潴钠、潴水与排钾，导致血容量增加，出现高血压与低钾血症。原发性高血压（A错）无低血钾及肌无力等表现。嗜铬细胞瘤（B错）以阵发性高血压为特征性表现，一般无低钾血症及肢体软弱无力。肾性高血压（C错）为由肾脏疾病引起的继发性高血压，往往在发现血压升高时已有蛋白尿、血尿和贫血、肾小球滤过功能下降（P259），一般无低血钾、肌无力等表现。库欣病（E错）患者典型病例表现为向心性肥胖、多血质外貌与满月脸，可出现高血压，但一般无明显的低钾血症、夜尿增多等表现。